女，24岁。腹痛、腹泻，便秘交替2年。便无脓血和黏液。近1年来消瘦、乏力、贫血。下午有时低热。首先考虑的诊断是
A. 小肠肿瘤
B. 克罗恩病
C. 溃疡性结肠炎
D. 降结肠癌
E. 升结肠癌

正确答案：B。克罗恩病

解析：青年女性患者，表现为腹痛、腹泻、便秘，且便无脓血和黏液，伴有消瘦、乏力、贫血等全身症状，应首先考虑的诊断为克罗恩病（B对）。克罗恩病多发生于15～30岁的青年人，主要表现为反复发作的右下腹或脐周痛、腹泻、体重下降，一般无脓血和黏液，常伴发热、肠梗阻、腹部压痛、腹块、肠瘘等。小肠肿瘤（P367）（A错）较少见，临床表现多不典型，可有腹痛、肠道出血、肠梗阻、腹部肿块、肠穿孔等表现。溃疡性结肠炎（九版内科学P373）（C错）主要表现为反复发作的腹泻、黏液脓血便和腹痛，常有里急后重，便后腹痛缓解。结肠癌（DE错）多见于中老年人，降结肠癌主要表现为肠梗阻、便秘、腹泻、便血等症状；升结肠癌（右侧结肠癌）以全身症状、贫血、右腹部肿块为主要表现。左侧结肠癌（降结肠癌）主要表现为肠梗阻、便秘、腹泻、便血。 右侧结肠癌（升结肠癌）主要表现为全身症状、贫血、右腹部肿块。